腹主动脉发出的成对脏支
A. 睾丸动脉
B. 子宫动脉
C. 肾上腺上动脉
D. 肾上腺下动脉
E. 腰动脉

正确答案：A。睾丸动脉

解析：睾丸动脉（A对）、卵巢动脉、肾上腺中动脉、肾动脉均为腹主动脉发出的成对脏支。